断面韧皮部有树脂状分泌物呈红棕色至黑棕色，与木部相间排列呈数个偏心性半圆形环，髓部偏向一侧的药材是
A. 桑寄生
B. 大血藤
C. 槲寄生
D. 沉香
E. 鸡血藤

正确答案：E。鸡血藤

解析：本题考查的是鸡血藤药材的鉴别。断面韧皮部有树脂状分泌物呈红棕色至黑棕色，与木部相间排列呈数个偏心性半圆形环，髓部偏向一侧的药材是鸡血藤（E对）。鸡血藤：【性状鉴别】药材呈椭圆形、长矩圆形或不规则的斜切片。栓皮灰棕色，有的可见灰白色斑块，栓皮脱落处显红棕色。质坚硬。切面木部红棕色或棕色，导管孔多数；韧皮部有树脂状分泌物呈红棕色至黑棕色，与木部相间排列呈数个同心性椭圆形环或偏心性半圆形环；髓部偏向一侧。气微，味涩。桑寄生（A错）：【性状鉴别】药材茎枝呈圆柱形；表面红褐色或灰褐色，具细纵纹，并有多数细小突起的棕色皮孔，嫩枝有的可见棕褐色茸毛；质坚硬，断面不整齐，皮部红棕色，木部色较浅。叶多卷曲，具短柄；叶片展平后呈卵形或椭圆形；表面黄褐色，幼叶被细茸毛，先端钝圆，基部圆形或宽楔形，全缘；革质。气微，味涩。大血藤（B错）：【性状鉴别】药材呈圆柱形，略弯曲。表面灰棕色，粗糙，外皮常呈鳞片状剥落，剥落处显暗红棕色，有的可见膨大的节及略凹陷的枝痕或叶痕。质硬，断面皮部红棕色，有数处向内嵌入木部，木部黄白色，有多数细孔状导管，射线呈放射状排列。气微，味微涩。槲寄生（C错）：【性状鉴别】药材茎枝呈圆柱形，2～5叉状分枝；表面黄绿色、金黄色或黄棕色，有纵皱纹；节膨大，节上有分枝或枝痕。体轻，质脆，易折断，断面不平坦，皮部黄色，木部色较浅，射线放射状，髓部常偏向一边。叶对生于枝梢，易脱落，无柄；叶片呈长椭圆状披针形；先端钝圆，基部楔形，全缘；表面黄绿色，有细皱纹，主脉5出，中间3条明显；革质。气微，味微苦，嚼之有黏性。沉香（D错）：【性状鉴别】药材呈不规则块状、片状或盔帽状，有的为小碎块。表面凹凸不平，有刀削痕，偶有孔洞，可见黑褐色树脂与黄白色木部相间的斑纹、孔洞及凹窝。表面多呈朽木状。质较坚实，断面刺状。气芳香，味苦。燃烧时有浓烟及强烈香气，并有黑色油状物渗出。